男性，36岁，1周来上腹痛，反酸，2小时前疼痛加重，呕血约200ml，呕血后疼痛减轻。为确诊出血原因，应立即做哪项检查
A. 紧急胃镜检查
B. 紧急钡透
C. 胃液分析
D. 急查血常规
E. 急查便隐血试验

正确答案：A。紧急胃镜检查

解析：慢性病程、周期性发作的节律性上腹疼痛是诊断消化性溃疡的重要线索，确诊有赖于胃镜检查。掌握“消化性溃疡”知识点。